根据社区卫生服务中心人员配备指导标准，辖区人员每万人至少配备多少名全科医生
A. 1
B. 2
C. 3
D. 4
E. 5

正确答案：B。2